知识、信念、态度、价值属于哪种影响行为的因素
A. 危险因素
B. 强化因素
C. 促成因素
D. 促进因素
E. 倾向因素

正确答案：E。倾向因素